明确脓肿诊断并确定其致病菌的可靠方法是
A. 抗生素治疗观察
B. 血液细菌培养
C. 穿刺细菌培养
D. 气味
E. 颜色

正确答案：C。穿刺细菌培养

解析：于脓肿部位穿刺进行细菌培养，是脓肿诊断以及致病菌的确定最为直接有效、可靠的方法，同时对于治疗、药物的选择也有重要的指导意义（C对）。抗生素治疗（A错）观察只能得知其敏感药物。血液细菌培养（B错）仅可以确定其致病菌而不能明确脓肿的诊断。气味（D错）、颜色（E错）等感官指标仅能通过经验对病情进行大概推断，并不能明确诊断。